一项关于HBV感染与原发性肝癌关系的成组病例对照研究中，109例肝癌患者中有98例HBV阳性，109例对照中有49例HBV阳性，则OR为
A. （49×11）/（98×60）
B. （98×60）/（49×11）
C. 18203
D. 11/49
E. 98/60

正确答案：B。（98×60）/（49×11）

解析：本题考查比值比（OR）的计算。比值比（OR）为病例组与对照组两组暴露比值之比。它恰好是四格表中两条对角线上的四个数字的交叉乘积比，即ad与bc之比。因此，OR＝（98×60）/（49×11）（B对ACDE错）。